肠外营养糖代谢紊乱可发生
A. 误吸
B. 腹胀腹泻
C. 微量元素缺乏
D. 高渗性非酮性昏迷
E. 胆囊结石胆泥淤滞

正确答案：D。高渗性非酮性昏迷

解析：由于输人大量高浓度的葡萄糖，而内生胰岛素一时不能相应增加，不能调节血糖水平所致，高渗导致细胞内脱水，进行性细胞内脱水可使细胞严重受损，所以肠外营养糖代谢紊乱可发生高渗性非酮性昏迷（D对）。昏迷、年老体弱或有胃潴留的患者，经鼻胃管输入营养液时会因呕逆而误吸，导致吸入性肺炎（A错）。肠内营养可能发生腹胀腹泻（B错）。微量元素缺乏时锌缺乏较多见，常发生于高分解状态并伴有明显腹泻者。在肠外营养液中常规加人微量元素可预防由于PN为时较长所产生的这些缺乏症（C错）。胆汁淤积由于长期不经口进食，十二指肠黏膜缺乏刺激而处于休眠状态，缩胆囊素（CCK）分泌减少，导致胆囊弛张胀大，胆汁淤积，胆泥生成，乃至形成胆石。胆汁滞留也损害肝功能（E错）。